申请医疗机构执业登记，应当具备的条件
A. 有设置医疗机构的批准书
B. 符合医疗机构的基本标准
C. 能够独立承担民事责任
D. 有适合的名称、组织机构和场所
E. 以上说法均正确

正确答案：E。以上说法均正确

解析：本题考查医疗机构登记和校验及法律责任。申请执业登记的条件申请医疗机构执业登记，应当具备下列条件：①有设置医疗机构的批准书（A对）；②符合医疗机构的基本标准（B对）；③有适合的名称、组织机构和场所（D对）；④有与其开展的业务相适应的经费、设施、设备和专业卫生技术人员；⑤有相应的规章制度；⑥能够独立承担民事责任（C对）。因此选E。